某男，56岁。1年前被确诊为肾结石、慢性肾炎、前列腺增生症。刻下血尿1天，伴腰腹疼痛、排尿不畅。经碎石治疗后，为巩固疗效，又请中医诊治，因工作繁忙无暇煎药，要求服用中成药，医师遂处以排石颗粒，以善其后。1月后患者复诊，诉云：连服上述中成药4周，刻下尿频、尿急、尿痛、尿线细及小腹拘急疼痛等均已缓解，唯见腰膝酸重、足踝浮肿、小便不利。医师诊断为肾阳不足、水湿内停所致的肾虚水肿，宜选用的中成药是
A. 济生肾气丸
B. 青娥丸
C. 薯蓣丸
D. 五苓散
E. 杞菊地黄丸

正确答案：A。济生肾气丸

解析：本题考查的是济生肾气丸的主治。唯见腰膝酸重、足踝浮肿、小便不利。医师诊断为肾阳不足、水湿内停所致的肾虚水肿，宜选用的中成药是济生肾气丸（A对）。济生肾气丸：【主治】肾阳不足、水湿内停所致的肾虚水肿、腰膝酸重、小便不利、痰饮咳喘。青娥丸（B错）：【主治】肾虚腰痛，起坐不利，膝软乏力。薯蓣丸（C错）：【主治】气血两虚，脾肺不足所致的虚劳、胃脘痛、痹病、闭经、月经不调。五苓散（D错）：【主治】阳不化气、水湿内停所致的水肿，症见小便不利、水肿腹胀、呕逆泄泻、渴不思饮。杞菊地黄丸（E错）：【主治】肝肾阴亏，眩晕耳鸣，羞明畏光，迎风流泪，视物昏花。